维生素D禁用于
A. 青光眼患者
B. 高钙血症
C. 高磷血症
D. 乳腺癌
E. 高脂血症

正确答案：B。高钙血症

解析：本题考查维生素D的禁忌症。维生素D禁用于高钙血症（B对）。维生素D能够引起高钙血症，从而诱发心律失常。青光眼（A错）是指眼内压间断或持续升高的一种眼病。高磷血症（C错）和高脂血症（E错）应慎用维生素D，其不良反应严重程度不及高钙血症。乳腺癌（D错）是乳腺上皮组织的恶性肿瘤。